以下各个选择中，不符合公共卫生伦理原则的一项是
A. 社会公益原则
B. 社会公正原则
C. 互相协同原则
D. 知情同意原则
E. 全社会参与原则

正确答案：D。知情同意原则

解析：公共卫生伦理原则包括：①全社会参与原则；②社会公益原则；③社会公正原则；④互助协同原则；⑤信息公开原则。掌握“公共卫生伦理含义、理论基础与原则”知识点。